瞳孔对光反射中枢位于
A. 脊髓
B. 延髓
C. 脑桥
D. 中脑
E. 下丘脑

正确答案：D。中脑

解析：瞳孔对光反射是指瞳孔在强光照射时缩小而在光线变弱时散大的反射。瞳孔对光反射的过程为：强光照射视网膜时产生的神经冲动沿视神经传到中脑（D对）的顶盖前区更换神经元，然后到达双侧动眼神经缩瞳核，再沿动眼神经中的副交感神经纤维传向睫状神经节，最后睫状神经节到达睫状体，使瞳孔括约肌收缩，瞳孔缩小。脊髓（A错）是内脏反射活动的初级中枢，基本的血管张力反射、发汗反射、排尿、反射、排便反射、阴茎勃起反射等可在脊髓水平完成。延髓（B错）是生命活动的基本中枢，心血管活动、呼吸运动、胃肠运动、消化腺分泌等基本反射中枢都位于延髓。脑桥（C错）参加呼吸节律的控制以及肌紧张和肌肉运动的调节。下丘脑（E错）是参与体温调节、水平衡调节、本能行为和情绪调节、内分泌活动调节以及生物节律控制等的中枢。